某男性患者，40岁。气喘发作2小时，检查发现呼吸急促，三凹征，缺氧，心率130次/分。治疗上除给予吸氧外，还应立即给予
A. 沙丁胺醇+氨茶碱
B. 肾上腺素+青霉素
C. 倍氯米松+沙丁胺醇
D. 氨茶碱+肾上腺素
E. 异丙肾上腺素+色甘酸钠

正确答案：C。倍氯米松+沙丁胺醇

解析：本题考查重度哮喘急性发作的治疗。40岁男性患者，气喘发作2小时，检查发现呼吸急促，三凹征，缺氧，心率130次/分，应诊断为哮喘急性发作（重度）。治疗上除给予吸氧外，还应立即给予倍氯米松+沙丁胺醇（C对）。氨茶碱（A错）口服可用于轻～中度急性哮喘发作以及哮喘的维持治疗；静脉给药主要用于重症和危重症哮喘。青霉素（B错）为抗感染药物，哮喘合并感染时可应用。肾上腺素（D错）是β受体激动剂可使支气管平滑肌松弛。